常用于细菌感染的血清学诊断试验不包括
A. 诊断伤寒、副伤寒的肥达试验
B. 检测立克次体的外-斐试验
C. 诊断钩端螺旋体病的显微凝集试验
D. 补体结合试验
E. 青霉素皮试

正确答案：E。青霉素皮试